女性，23岁。2小时前口服50％敌敌畏60ml，大约10分钟后出现呕吐、大汗，随后昏迷，急送入院。检查：呼吸急促，32次/分，血压18.7/13.3kPa（140/100mmHg），心律紊乱，肠鸣音亢进，双侧瞳孔1～2mm，胸前有肌颤，全血ChE活力为30％。病人入院后，除给洗胃和给氯解磷定治疗外，还应立即注射何种药物抢救
A. 氯丙嗪
B. 普萘洛尔
C. 阿托品
D. 毛果芸香碱
E. 新斯的明

正确答案：C。阿托品